某男，68岁。因感冒、发热、头痛、鼻塞流涕四肢乏力等不适症状就诊，测体温39℃，医师开具吲哚美辛栓退热。不宜与该药联用的中成药是
A. 清开灵胶囊
B. 感冒软胶囊
C. 新癀片
D. 连花清瘟颗粒
E. 疏风解毒胶囊

正确答案：C。新癀片

解析：本题考查的是含西药组分的中成药。因感冒、发热、头痛、鼻塞流涕四肢乏力等不适症状就诊，测体温39℃，医师开具吲哚美辛栓退热。不宜与该药联用的中成药是新癀片（C对）。新癀片：功能清热解毒，活血化瘀，消肿止痛。用于热毒瘀血所致的咽喉肿痛、牙痛、痹痛、胁痛、黄疸、无名肿毒。含西药成分吲哚美辛。故不宜与吲哚美辛栓联用，避免重复用药。清开灵胶囊（A错）：功能清热解毒，镇静安神。用于外感风热时毒、火毒内盛所致高热不退、烦躁不安、咽喉肿痛、舌质红绛、苔黄、脉数者；上呼吸道感染、病毒性感冒、急性化脓性扁桃体炎、急性咽炎、急性气管炎、高热等病症属上述证候者。含西药成分猪去氧胆酸、黄芩苷。感冒软胶囊（B错）、连花清瘟颗粒（D错）与疏风解毒胶囊（E错）均不含西药成分。